当支气管哮喘与心源性哮喘一时难以鉴别时，可使用下列哪项药物以缓解症状
A. 肾上腺素
B. 毛花苷C
C. 吗啡
D. 氨茶碱
E. 呋塞米

正确答案：D。氨茶碱

解析：氨茶碱在支气管哮喘与心源性哮喘中均可应用，并有较好疗效（D对）。肾上腺素（A错）临床主要用于心脏骤停、支气管哮喘和过敏性休克。毛花苷C（B错）用于急性心力衰竭、慢性心力衰竭性加重、快速室率的心房颤动、心房扑动和阵发性室上性心动过速。吗啡（C错）常用作强效镇痛剂。呋塞米（E错）是治疗充血性心力衰竭和水肿的袢利尿药。